既敛肺降火，又敛汗止血的药是
A. 石榴皮
B. 五倍子
C. 金樱子
D. 五味子
E. 浮小麦

正确答案：B。五倍子

解析：本题考查五倍子的功效。既敛肺降火，又敛汗止血的药是五倍子（B对）。五倍子【功效】敛肺降火，涩肠固精，敛汗止血，收湿敛疮。石榴皮（A错）【功效】涩肠止泻，止血，杀虫。金樱子（C错）【功效】固精缩尿，涩肠止泻，固崩止带。五味子（D错）【功效】收敛固涩，益气生津，滋肾宁心。浮小麦（E错）【功效】益气，除热止汗。